“环境烟草烟雾暴露”又称为
A. 公共场所吸烟
B. 图书馆吸烟
C. 主动吸烟
D. 使用无烟香烟
E. 二手烟

正确答案：E。二手烟

解析：“二手烟”又称“环境烟草烟雾暴露”，是指不吸烟者吸入吸烟者呼出的主流烟雾及卷烟燃烧产生的侧流烟雾。掌握“干预基本模式及烟草行为干预”知识点。